说明液体量己补充足
A. 中心静脉压很低，尿量多
B. 中心静脉压偏低，尿量少
C. 中心静脉压偏低，尿量多
D. 中心静脉压很高，尿量多
E. 中心静脉压很高，尿量少

正确答案：D。中心静脉压很高，尿量多

解析：中心静脉压代表了右心房或者胸腔段腔静脉内压力变化，可反映全身血容量与右心功能之间的关系，中心静脉压很高表示血容量充足；尿量反映肾脏的灌注，尿量多说明肾灌注充足，说明机体血容量充足。综上，中心静脉压很高，尿量多提示液体量已补充足（D对）。一般不存在中心静脉压低，尿量多的临床表现（AC错）。中心静脉压偏低，尿量少提示血容量不足（B错）。中心静脉压很高，尿量少，提示心功能不全（E错）。